使津液变成汗尿是气的
A. 推动作用
B. 防御作用
C. 气化作用
D. 固摄作用
E. 中介作用

正确答案：C。气化作用

解析：气化，指人体精、气、血、津液各自的代谢及其相互转化；使津液变成汗尿是气化作用的体现（C对）。气的推动作用指气的激发和推动功能（A对）；气的防御作用是指气有卫护机体、抗御邪气的作用（B错）；气的固摄作用是指气对体内精、血、津液等物质具有防止其无故流失的作用（D错）；气的中介作用，主要指气能感应传导信息以维系机体整体联系的作用（E错）。